先天缺陷是指婴儿在出生前已形成了
A. 形态结构异常
B. 功能发育不全
C. 先天脑发育不全
D. 低出生体重
E. 发育障碍

正确答案：E。发育障碍

解析：本题考查先天缺陷的相关内容。先天缺陷是指婴儿在出生前即已形成的发育障碍（E对ABCD错），包括形态结构异常、代谢功能异常的先天畸形和先天性智力低下等，因其各种发育障碍均发生于出生前，故名为先天缺陷。